受体的特异性取决于
A. 活性中心的构象和活性基团
B. 结合域的构象和活性基团
C. 细胞膜的构象和活性基团
D. 信息传导部分的构象和活性基团
E. G蛋白的构象和活性基团

正确答案：B。结合域的构象和活性基团